脑电图的基本波形不包括哪种波形
A. α
B. β
C. θ
D. δ
E. γ

正确答案：E。γ